以下对牙颈曲线的描述哪个是错误的
A. 牙颈缘在牙冠各轴面均呈弧形曲线
B. 颈曲线在唇颊面成凸向（牙合）缘方的弧线
C. 颈曲线在近中面呈凸向（牙合）缘方的弧线
D. 颈曲线在远中面呈凸向（牙合）缘方的弧线
E. 颈曲线在舌面呈凸向根方的弧线

正确答案：B。颈曲线在唇颊面成凸向（牙合）缘方的弧线

解析：本题考查牙颈曲线。对牙颈曲线的描述错误的是颈曲线在唇颊面成凸向（牙合）缘方的弧线（B错，为本题的正确答案）。牙颈曲线为牙冠与牙根交界处形成的弧形曲线，又称颈缘或牙颈。牙颈缘在牙冠各个方向均呈弧形曲线（A对），在唇、颊、舌面凸向根方（E对）而不是凸向（牙合）方，在近远中面凸向（牙合）方（CD对）。